对伴有大量痰液并阻塞呼吸道的病毒性感冒患者，在服用镇咳药的同时，应及时联合应用的药品是
A. 左氧氟沙星
B. 羧甲司坦
C. 泼尼松龙
D. 多索茶碱
E. 右美沙芬

正确答案：B。羧甲司坦

解析：本题考查羧甲司坦。对伴有大量痰液并阻塞呼吸道的病毒性感冒患者，在服用镇咳药的同时，应及时联合应用的药品是羧甲司坦（B对）。羧甲司坦为黏液调节剂，主要调节支气管腺体分泌，增加低黏度的唾液黏蛋白分泌，减少高黏度的岩藻黏蛋白产生，使痰液黏滞性降低，易于咳出；也能加强呼吸道纤毛运动，促进痰液排出。适用于各种呼吸道疾病引起的痰液黏稠、咳出困难者，亦可用于手术后咳痰困难者。左氧氟沙星（A错）适用于敏感细菌感染所致的中、重度感染，对病毒型感染无效。波尼松龙（C错）是糖皮质激素类药物，用于支气管哮喘的慢性持续期治疗。多索茶碱（D错）为平喘药，用于支气管哮喘、喘息性慢性支气管炎及其他支气管痉挛引起的呼吸困难。右美沙芬（E错）是中枢性镇咳药，用于各种原因引起的干咳，包括上呼吸道感染（如感冒和咽炎）、支气管炎等引起的咳嗽。